磺脲类药降糖的主要机制是
A. 加速无氧糖酵解
B. 促进外周组织摄取葡萄糖
C. 抑制肠道对葡萄糖的吸收
D. 刺激胰岛β细胞释放胰岛素
E. 促使靶细胞胰岛素受体亲和力增强

正确答案：D。刺激胰岛β细胞释放胰岛素

解析：由于磺脲类属于促胰岛素分泌剂，此类药物主要作用于胰岛β细胞表面的受体，可促进胰岛素释放（D对）。加速无氧糖酵解的药物是双胍类（A错）。双胍类主要药理作用是促进外周组织对葡萄糖的摄取（B错），抑制肠道对葡萄糖的吸收（C错），增加肌肉内葡萄糖的无氧酵解，抑制糖原的异生，增加靶组织对胰岛素的敏感性。促使靶细胞胰岛素受体亲和力增强的药物是格列奈类（E错）。